患者无明显诱因突然发作上腹痛，按压后疼痛减轻。应首先考虑的是
A. 胃下垂
B. 胃穿孔
C. 胃痉挛
D. 胃溃疡
E. 急性胃炎

正确答案：C。胃痉挛

解析：本例患者无明显诱因突发上腹痛，按压后疼痛减轻，诊断应首先考虑胃痉挛（C对）。胃痉挛是指胃壁平滑肌痉挛所导致的胃部疼痛。胃下垂（A错）腹痛特点为持续性隐痛，常于餐后发生，与进食量有关。胃穿孔（B错）腹痛特点为突发剧烈腹痛。胃溃疡（D错）腹痛特点为中上腹持续性隐痛，进餐后加重。急性胃炎（E错）多见于口服非甾体抗炎药患者，腹痛特点为无规律上腹痛。